患者女、40岁，双侧腮腺区反复肿大，伴有双眼异物感、无泪、口干、饮水量增加。检查发现：双侧腮腺肿大、质软、无压痛；张口度正常，腮腺导管口无红肿，挤压出清亮液、无脓血、口腔黏膜干燥、发红。腮腺导管口无红肿，挤压出清亮液，询问病史对鉴别诊断帮助不大的是
A. 服药史
B. 糖尿病史
C. 婚育史
D. 头颈部放疗史
E. 结缔组织病史

正确答案：C。婚育史

解析：患者女、40岁，双侧腮腺区反复肿大，伴有双眼异物感、无泪、口干、饮水量增加。检查发现：双侧腮腺肿大、质软、无压痛；张口度正常，腮腺导管口无红肿，挤压出清亮液、无脓血、口腔黏膜干燥、发红。腮腺导管口无红肿，挤压出清亮液，询问病史对鉴别诊断帮助不大的是婚育史（C错，为本题的正确答案）。糖尿病（B对）患者的主要口腔表征有口腔黏膜干燥，充血发红，透明度下降，唇部干裂；服用一些药物可使腺体分泌减少（A对）；头颈部放射治疗可使腺体分泌减少，口干（D对）。舍格伦综合征患者可伴有结缔组织疾病（E对），约占50%的患者伴有类风湿关节炎，约占10%的患者伴系统性红斑狼疮。此外，尚可有硬皮病、多发性肌炎等。